第二肝门位于肝脏
A. 左纵沟后部
B. 右纵沟前部
C. 下腔静脉沟上端
D. 下腔静脉沟下端
E. 肝管、门静脉和肝动脉出入肝脏处

正确答案：C。下腔静脉沟上端

解析：第二肝门位于肝脏下腔静脉沟上端(C对D错)，左纵沟后部(A错)为静脉韧带裂，容纳静脉韧带，右纵沟前部(B错)为胆囊窝，容纳胆囊，肝左中右静脉出入肝脏处(E错)